既能利水渗湿，又能健脾的药物是
A. 猪苓
B. 泽泻
C. 茯苓
D. 车前子
E. 滑石

正确答案：C。茯苓

解析：茯苓的功效是利水渗湿，健脾，宁心（C对）。猪苓的功效是利水渗湿（A错）。泽泻的功效是利水渗湿，泄热（B错）。车前子的功效是利尿通淋，渗湿止泻，明目，祛痰（D错）。滑石的功效是利尿通淋，清热解暑，收湿敛疮（E错）。